在医学道德评价中，我们应坚持
A. 目的决定论
B. 手段决定论
C. 目的决定手段论
D. 目的手段辩证统一论
E. 目的手段对立论

正确答案：D。目的手段辩证统一论

解析：目的与手段的统一 医学目的是指医务人员在医疗实践活动中期望达到的目标。医学手段是指医务人员为达到某种目标所采取的方法和途径。在医疗实践活动中，要按照医德原则的要求，严格遵循有效性、最优性、一致性和社会性原则，确立正确的医学目的，选择适合、恰当的医疗手段。所选择的医疗手段必须经过科学实践证明是有效的、具有最佳效果的、与患者病情发展变化相一致的、没有社会后果的。进行医德评价时，要始终坚持目的与手段的高度统一（D对CE错）。目的论认为评价行为善恶，只需依据行为目的，即只需评价行为的目的是否合乎道德，至于达到这个目的而采取何种手段并不重要（A错）。手段不具有道德评价意义。手段是指人们实现目标所借助的工具、方法、途径等，手段论认为只需依据行为手段合乎道德与否，行为目的并不重要，目的不具有道德评价意义（B错）。